乙醇用于皮肤消毒及体温计浸泡消毒的适宜浓度是
A. 0.25
B. 0.5
C. 0.75
D. 0.95
E. 1

正确答案：C。0.75

解析：醇类：70%～75%乙醇或异丙醇，用于皮肤消毒及体温计浸泡消毒。掌握“消毒与灭菌”知识点。